依照《医疗用毒性药品管理办法》，收购、经营、加工、使用毒性药品的单位必须做到
A. 划定仓间或仓位
B. 建立健全保管、验收、领发、核对制度
C. 专用账册
D. 专柜加锁
E. 专人保管

正确答案：A、B、C、D、E。划定仓间或仓位；建立健全保管、验收、领发、核对制度；专用账册；专柜加锁；专人保管

解析：本题考查毒性药品的储存管理要求。依照《医疗用毒性药品管理办法》，收购、经营、加工、使用毒性药品的单位必须做到划定仓间或仓位（A对）；建立健全保管、验收、领发、核对制度（B对）；专用账册（C对）；专柜加锁（D对）；专人保管（E对）。毒性药品的储存管理要求与麻醉药品的储存管理要求基本相同。收购、经营、加工、使用毒性药品的单位必须建立健全保管、验收、领发、核对等制度，严防收假、发错，严禁与其他药品混杂。储存毒性药品的专库或专柜，其条件要求与储存麻醉药品的专库条件相同，毒性药品可与麻醉药品存放在同一专用库房或专柜中。专库或专柜加锁并由专人保管，做到双人双锁管理，专账记录。《医疗用毒性药品管理办法》第六条：收购、经营、加工、使用毒性药品的单位必须建立健全保管、验收、领发、核对等制度，严防收假、发错，严禁与其他药品混杂，做到划定仓间或仓位，专柜加锁并由专人保管。毒性药品的包装容器上必须印有毒药标志。在运输毒性药品的过程中，应当采取有效措施，防止发生事故。